充填术中，垫基底的目的是
A. 隔绝刺激，保护牙髓
B. 为了加强抗力
C. 为了加强消毒
D. 为了加强固位

正确答案：A。隔绝刺激，保护牙髓

解析：本题考查垫底的目的。垫底是在洞底垫一层足够厚度的材料，隔绝外界和充填材料刺激，保护牙髓（A对），同时有垫平洞底形成窝洞，承受充填压力和咀嚼力的作用。窝洞制备时制备一定的抗力形是为了加强抗力（B错）。充填前进行窝洞多次消毒是为了加强消毒（C错）。窝洞制备时制备一定的固位形是为了加强固位（D错）。